治疗闭经痰湿阻滞证，应首选
A. 左归丸
B. 右归丸
C. 归肾丸
D. 血府逐瘀汤
E. 丹溪治湿痰方

正确答案：E。丹溪治湿痰方

解析：闭经之痰湿阻滞证的病机是痰湿下注，冲任壅塞，胞脉闭塞，治疗应燥湿化痰，活血通经，方用燥湿化痰，补气调经的丹溪治湿痰方（E对）。血府逐瘀汤（D错）适用于闭经之气滞血瘀证。归肾丸（C错）适用于闭经之肝肾不足证；治疗多囊卵巢综合征的肾阴虚证用左归丸（A错）、肾阳虚用右归丸（B错）。